变异系数表示
A. 平均水平
B. 对称分布
C. 离散趋势
D. 相对变异度
E. 集中趋势

正确答案：D。相对变异度

解析：本题考查定量资料的统计描述和推断。变异系数用CV表示，用于比较度量单位不同或均数相差悬殊的两组（或多组）资料的变异程度（D对）。意义：值越大，意味着相对于均数而言，变异程度越大。